颈丛发出
A. 膈神经
B. 阴部神经
C. 闭孔神经
D. 肌皮神经
E. 肋间神经

正确答案：A。膈神经

解析：颈丛的主要分支有：枕小神经、耳大神经、颈横神经、锁骨上神经、膈神经（A对）。阴部神经（B错）为骶丛的分支。闭孔神经（C错）为腰丛的分支。肌皮神经（D错）为臂丛的分支。肋间神经（E错）为胸神经的分支。